急诊病人，男性。昏迷，轻度黄疸，口中腥臭味，双侧肢体肌张力对称性增高，瞳孔等大，尿蛋白和尿糖均为阴性，分别为20g/L和35g/L。应首先考虑的诊断是
A. 脑血管意外
B. 肝性脑病
C. 糖尿病酮症
D. 尿毒症
E. 有机磷杀虫药中毒

正确答案：B。肝性脑病

解析：肝性脑病是由严重肝病引起，以代谢紊乱为基础的中枢神经系统功能失调综合征，以意识障碍，行为失常和昏迷为主要临床表现（B对）。脑血管意外可有头痛、眩晕、呕吐、意识丧失、肢体瘫痪、偏盲或失语、感觉障碍等表现（A错）。糖尿病酮症以高血糖、酮症、酸中毒为主要表现，早期“三多一少”症状加重：酸中毒失代偿后，疲乏、恶心、呕吐、多尿、头痛、嗜睡、呼吸深快，呼气中有烂苹果味；后期严重失水，尿量减少。眼眶下陷，皮肤黏膜干燥。血压下降，心率加快，晚期不同程度意识障碍，昏迷（C错）。尿毒症常在肾脏原发疾病基础上缓慢出现，伴有贫血、抽搐（D错）。有机磷杀虫药中毒以神经肌肉系统功能障碍为主要特征，主要表现为呼出大蒜味气体、瞳孔呈针尖样缩小，大汗淋漓，流口水，气管分泌物增多，意识昏迷或障碍等（E错）。